沈某，男，28岁。外生殖器及肛门出现单个质坚韧丘疹，四周焮肿，腹股沟部有杏核样大、色白坚硬之肿块，伴口苦纳呆，尿短赤，大便秘结，舌苔黄腻，脉弦数。西医诊断为梅毒。其证候是
A. 肝经湿热
B. 痰瘀互结
C. 脾虚湿蕴
D. 气血两虚
E. 气阴两虚

正确答案：A。肝经湿热

解析：梅毒是由梅毒螺旋体所引起的一种全身性、慢性性传播疾病，中医认为本病为淫秽疫毒与湿热、风邪杂合所致，肝经环绕阴器走行，湿热循肝经而下，则见外生殖器及肛门出现疳疮，为一期梅毒，肝经湿热，湿浊困阻气机，则见口苦纳呆，大便秘结，尿短赤，舌苔黄腻，脉弦数均为肝经湿热之象（A对）。若为痰瘀互结，应可见头重身困，恶心呕吐，口中黏腻，舌暗，可见瘀点或瘀斑，舌苔白腻，脉沉涩（B错）。若为脾虚湿蕴应可见四肢无力，面色㿠白，纳呆，便溏，舌淡苔白，脉细弱（C错）。若为气血两虚可见气短懒言，精神疲倦，面色淡白无华，自汗，舌淡苔白，脉细弱（D错）。若为气阴两虚，应可见乏力、气短、自汗或者盗汗，五心烦热，大便秘结，舌淡或舌红，苔薄白少津，或少苔，脉细弱（E错）。